融合牙好发龋病的部位是
A. 舌侧窝
B. 生长线
C. 唇面
D. 融合线
E. 牙颈部

正确答案：D。融合线

解析：融合牙的融合线处是龋齿的好发部位。掌握“迟萌、多生牙和融合牙”知识点。